以下哪种情况不是根管再治疗的非适应证
A. 根管充填材料无法取出
B. X线片根尖透射影达到根长的1/3
C. 不能进行彻底的根管预备
D. 根管欠填的患牙
E. 髓室底有大的穿孔

正确答案：D。根管欠填的患牙

解析：患牙病因复杂，难以进行根管再治疗。如：①根管充填材料无法取出；②不能进行彻底的根管预备；③X线片根尖透射影达到根长的1/3；④根管内的根充材料、分离器械可能会进入根尖周病变区内；⑤髓室底有大的穿孔；⑥牙根中份到根尖部根管壁穿孔；⑦根周牙槽骨吸收达根长的1/2；⑧牙齿松动度2度以上；⑨牙周袋与根尖周病变已连通。掌握“根管再治疗”知识点。